下列各项，不属“惊风四证”的是
A. 痰
B. 瘀
C. 热
D. 惊
E. 风

正确答案：B。瘀

解析：急惊风来势急骤，临床以高热伴抽搐、昏迷为特征，多由外感时邪疫疠以及暴受惊恐引起，以痰、热、惊、风四证为主要临床特点，急惊风的病机中无“瘀”（B错，为本题正确答案）这一病理因素。痰（A对）分为痰热、痰火、痰浊，神志昏迷，高热痰鸣，为痰热上蒙清窍；妄言谵语，狂躁不宁，为痰火上扰清空；深度昏迷，嗜睡不动，为痰浊内蒙心包，阻蔽心神，为“惊风四证”之一。热（C对）分为表热、里热：昏迷、抽搐为一过性，热退后抽搐自止为表热；高热持续，反复抽搐、昏迷为里热，为"惊风四证"之一。惊（D对）即抽搐、惊厥等症状，为"惊风四证"之一。风（E对）分为外风、内风：外风邪在肌表，清透宣解即愈，如高热惊厥，为一过性证候，热退惊风可止；内风病在心肝，热、痰、惊、风四证俱全，反复抽搐，神志不清，病情严重，为“惊风四证”之一。